下列哪项不属于闭合性骨折切开复位内固定的适应症
A. 骨折端间有软组织嵌插，手法复位失败
B. 关节内骨折，手法复位对位不好
C. 并发主要血管损伤
D. 并发主要神经损伤
E. 未达到解剖复位

正确答案：E。未达到解剖复位

解析：闭合性骨折指骨折处皮肤及筋膜或骨膜完整，骨折端不与外界相通，其复位方法有手法复位和切开复位。切开复位可使手法复位不能复位的骨折达到解剖复位，且切开复位后大多需要内固定。解剖复位和功能复位都是骨折的复位标准，达到功能复位标准时可不强求解剖复位（E错，为本题正确答案）。切开复位的指征有1）骨折端之间有肌肉或肌腱等软组织嵌入（A对）；2）关节内骨折可能影响关节功能者（B对）；3）手法复位未能达到功能复位的标准，将严重影响患肢功能者；4）骨折并发主要血管（C对）、神经损伤（D对），修复血管、神经的同时，宜行骨折切开复位；5）多处骨折，为便于护理和治疗，防止并发症，应行切开复位；6）不稳定性骨折，如四肢斜形、螺旋形、粉碎性骨折及脊柱骨折合并脊髓损伤者。